干咳少痰，午后咳嗽加重，伴五心烦热、颧红者，证属
A. 痰热壅肺
B. 肝火犯肺
C. 肺肾阴虚
D. 风热感冒
E. 肝肾阴虚

正确答案：C。肺肾阴虚

解析：本题考查的是肺肾阴虚证的临床表现及辨证要点。干咳少痰，午后咳嗽加重，伴五心烦热、颧红者，证属肺肾阴虚（C对）。肺肾阴虚证的临床表现及辨证要点：肺肾阴虚证的临床表现，常见咳嗽痰少，动则气促，间或咯血，腰膝酸软，消瘦，骨蒸潮热，盗汗遗精，颧红，舌红苔少，脉细数。这些症状，均由肺肾阴虚、阴虚内热、虚火上炎所引起。一般以久咳痰血、腰膝酸软、遗精等症与阴虚症状同见为辨证要点。痰热壅肺（A错）为咳嗽的辨证，咳嗽痰热壅肺证：【症状】喘咳气涌，胸部胀痛，痰稠黏色黄，或夹血痰，伴胸中烦闷、身热、有汗、口渴喜冷饮、咽干、面红、尿赤、便秘。舌质红，苔薄黄腻，脉滑数。肝火犯肺（B错）证的临床表现及辨证要点：肝火犯肺证的临床表现，常见胸胁窜痛，咳嗽阵作，甚则咯吐鲜血，性急善怒，烦热口苦，头眩目赤，舌质红，舌苔薄，脉弦数。这些症状，均由肝郁气滞、气郁化火、肝火上逆犯肺所引起。一般以胸胁灼痛、急躁易怒、目赤口苦、咳嗽为辨证要点。风热感冒（D错）为感冒的辨证。风热感冒：【症状】身热较著，微恶风，头胀痛，或咳嗽少痰，或痰出不爽，咽痛咽红，口渴。舌边尖红，苔薄白或微黄，脉浮数。肝肾阴虚（E错）证的临床表现及辨证要点：肝肾阴虚证的临床表现，常见头晕目眩，耳鸣，胁痛，腰膝酸软，咽干，颧红，盗汗，五心烦热，男子或见遗精，女子或见月经不调，舌红无苔，脉细数。肝肾阴虚，虚火上扰，故见头晕目眩、耳鸣、咽干、颧红等症。肝脉布两胁，肝阴不足，则经脉失养故胁痛。腰为肾之府，肾主骨，肝主筋，膝为筋之府，肝肾阴虚，故腰膝酸软。肾阴亏虚，虚火内生，扰动精室，故男子可见遗精。肝肾阴虚，冲任失调，在女子可致月经不调。五心烦热、盗汗、舌红无苔、脉细数，均为阴虚内热之征象。一般以胁痛、腰膝酸软、耳鸣、遗精与阴虚内热症状同见为辨证要点。